5个月男婴，体温38℃，咳嗽、喘憋明显。查体：呼吸急促，鼻扇三凹征明显，双肺听诊满布哮鸣音，偶有闻中小水泡音，胸部X片：纵侧肺纹理增强，可见小片状阴影，肺气肿改变明显，可诊断为
A. 呼吸道合胞病毒肺炎
B. 肺炎支原体肺炎
C. 腺病毒肺炎
D. 金黄色葡萄球菌肺炎
E. 衣原体肺炎

正确答案：A。呼吸道合胞病毒肺炎

解析：患儿，发热、喘憋、鼻扇三凹征明显、双肺听诊满布哮鸣音，符合呼吸道合胞病毒肺炎的特点，应诊断为呼吸道合胞病毒肺炎（A对）。肺炎支原体肺炎和衣原体肺炎都是多见于学龄前儿童（婴幼儿很少见），肺炎支原体肺炎的特征性表现是刺激性干咳，衣原体肺炎的咳嗽可持续1～2个月，因此不能诊断为肺炎支原体肺炎（B错）和衣原体肺炎（E错）。腺病毒肺炎一般见于6个月～2岁的儿童（5个月婴儿少见），典型的临床表现是频繁咳嗽，三凹征很少见，不符合该患儿的各种表现，不能诊断为腺病毒肺炎（C错）。金黄色葡萄球菌肺炎的病变发展迅速，组织破坏严重，易形成肺脓肿、脓胸及其他器官的迁徙性化脓灶，该病例不符合金黄色葡萄球菌肺炎的特点（D错）。